女，50岁。饱餐后饮酒出现上腹部持续疼痛6小时，呈腰背部放射。前屈位可稍缓解，呕吐物为胃内容物，呕吐后不缓解。查体：T37.1℃，P112次/分，R24次/分，BP100/70mmHg。全腹压痛，以上腹为著，可见肌紧张，无反跳痛，Murphy征阴性，肠鸣音2次/分，腹部B超提示：胆囊结石，胰腺肿大，回声减低。对明确诊断最有价值的检查是
A. 胃镜
B. 血淀粉酶
C. 结肠镜
D. 腹部立位X线平片
E. 血胆红素

正确答案：B。血淀粉酶

解析：患者有胆囊结石（胆道疾病高危因素），饱餐后饮酒（AP常见诱因）出现上腹部持续疼痛，向腰背部放射，呕吐物为胃内容物，呕吐后不缓解（AP特异症状）。全腹压痛，以上腹为著，可见肌紧张，肠鸣音减弱（腹膜炎体征）。轻度发热，脉搏细速、血压下降。胰腺肿大，回声减低（胰腺有水肿）。最有可能的诊断是急性胰腺炎。血清、尿淀粉酶测定是最常用的诊断方法。血清淀粉酶在发病数小时开始升高，24小时达高峰，4-5天后逐渐降至正常。尿淀粉酶在24小时才开始升高，48小时到高峰，下降缓慢，1-2周后恢复正常。因此对明确诊断最有价值的检查是血淀粉酶（B对）。